生长趋势判别，体重低偏的是
A. 儿童生长曲线与参考曲线走向相平行
B. 本次体重值减上次体重值虽为正数，但其增长值低于该月龄增长的最低值
C. 本次体重值减上次体重值等于零，儿童生长曲线不与参考曲线走向平行，而与横轴平行
D. 本次体重值减上次体重值等于负数，儿童生长曲线与参考曲线走向相反
E. 本次体重值减上次体重值等于负数，但其增长值低于该月龄增长的最低值

正确答案：B。本次体重值减上次体重值虽为正数，但其增长值低于该月龄增长的最低值

解析：本题考查生长趋势判别。体重低偏：即本次体重值减上次体重值虽为正数，但其增长值低于该月龄增长的最低值（B对E错）。生长趋势判别：（1）正常曲线：即儿童生长曲线与参考曲线走向相平行（A错）；（2）体重不增：即本次体重值减上次体重值等于零，儿童生长曲线不与参考曲线走向平行，而与横轴平行（C错）；（3）体重下降：即本次体重值减上次体重值等于负数，儿童生长曲线与参考曲线走向相反（D错）；（4）体重低偏：即本次体重值减上次体重值虽为正数，但其增长值低于该月龄增长的最低值。